梅毒的病原体是
A. 单纯疱疹病毒
B. 苍白密螺旋体
C. 人免疫缺陷病毒
D. 人乳头瘤病毒
E. 革兰阴性双球菌

正确答案：B。苍白密螺旋体

解析：梅毒的病原体是苍白密螺旋体（B对），单纯疱疹病毒感染（A错）引起生殖器疱疹，人免疫缺陷病毒（C错）感染引起艾滋病，人乳头瘤病毒（D错）感染引起尖锐湿疣，革兰阴性双球菌（E对）（淋病奈瑟菌）感染引起淋病。